男，45岁，体检发现血压150/96mmHg，心率80次/分，血糖8.0mmol/L，HbALC8.0%，血蛋白酶500umol/L，该患者首选降压药
A. 氢氯噻嗪
B. 硝苯地平缓释片
C. 依那普利
D. 美托洛尔
E. 氯沙坦

正确答案：C。依那普利

解析：患者中年男性，血压150/96mmHg（正常值90～139/60～89mmHg，提示为高血压1级），提示患者为高血压1级，血糖8.0mmol/L，HbALC8.0%，提示患者有糖尿病。因此患者可诊断为糖尿病伴高血压。对于高血压合并糖尿病的患者首选降压药是血管紧张素转化酶抑制剂（ACEI）。依那普利（C对）属于ACEI类降压药，其可抑制交感-肾素-血管紧张素-醛固酮系统，扩张外周血管而降低血压；还可改善胰岛素抵抗、减少尿蛋白形成，特别适合于高血压合并糖尿病的患者。氢氯噻嗪（A错）属于噻嗪类利尿剂，可使血脂、血糖、血尿酸升高，美托洛尔（D错）属于选择性β₁受体阻滞剂，能增加胰岛素抵抗，还可能掩盖和延长低血糖反应（P253），故两者都不适合用于高血压合并糖尿病的患者。硝苯地平（P255）（B错）属于钙通道阻滞剂，对血脂、血糖等无明显影响，可用于糖尿病伴高血压患者，但一般不作为首选。氯沙坦（P255）（E错）属于血管紧张素Ⅱ受体阻滞剂，在患者不宜使用ACEI类药物时才考虑使用。